精神卫生工作的方针、原则和管理机制说法有误的是
A. 精神卫生工作实行预防为主的方针
B. 坚持预防和治疗相结合的原则
C. 实行政府组织领导、部门各负其责
D. 实行家庭和单位尽力尽责、全社会共同参与
E. 实行综合管理机制

正确答案：B。坚持预防和治疗相结合的原则